吸烟是肺癌的危险因素，下列吸烟的相关因素中与肺癌关系不密切的是
A. 烟草燃烧所产生的一氧化碳量
B. 吸烟量
C. 烟草中尼古丁含量
D. 烟草中焦油含量
E. 吸烟年数

正确答案：C。烟草中尼古丁含量

解析：烟草中尼古丁含量（C错，为本题正确答案）与成瘾有关。肺癌的发生和吸烟量（B对）、焦油含量（D对）、吸烟年数（E对）是密切相关的，一氧化碳 (CO) 是烟草烟雾中的主要成分，CO与血红蛋白结合，而导致机体处于相对低氧状态，为了应对低氧，红细胞体积和数目代偿性增加红细胞体积和数目的增加使血黏滞度增加，导致体内处于高凝状态，呼吸道长期受一氧化碳的刺激，呼吸道上皮组织异常增生，导致癌化发展（A对）。